由A组溶血性链球菌导致的小儿急性上呼吸道感染，可继发的疾病是
A. 风湿热
B. 中耳炎
C. 鼻窦炎
D. 肺炎
E. 心力衰竭

正确答案：A。风湿热

解析：A组溶血性链球菌感染导致的急性上呼吸道感染，可继发急性肾小球肾炎和风湿热。掌握“急性上呼吸道感染”知识点。